下列哪项不是HIV感染的口腔表现
A. 天疱疮
B. 单纯疱疹
C. 念珠菌病
D. 卡波西肉瘤
E. 坏死性牙龈炎

正确答案：A。天疱疮

解析：本题考查HIV感染的口腔表现。天疱疮不属于HIV感染的口腔表现（A错，为本题的正确答案）。天疱疮在口腔的临床表现出现掲皮试验阳性和探针试验阳性，在皮肤易出现于前胸，躯干以及头皮、颈、腋窝、腹股沟等易受摩擦处，会出现大小不等的水疱，疱不融合，疱壁薄而松弛，疱液清澈或微浊。HIV感染会导致艾滋病，其口腔表现是：1.真菌感染：口腔念珠菌病（C对）；组织包浆菌病，为发生于舌、腭、颊部的慢性肉芽肿或较大的溃疡、坏死。2.病毒感染：毛状白斑；单纯疱疹（B对）；带状疱疹；巨细胞病毒感染，口腔黏膜表现为溃疡；乳头状瘤、局灶性上皮增生，为口腔疣状损害。3.卡波西肉瘤（D对），为一种罕见的恶性肿瘤，在口腔中好发于腭部和牙龈。4.HIV相关性牙周病：牙龈线性红斑，表现为游离龈界限清楚火红色的充血带；HIV相关性牙周炎，牙周附着丧失，进展快，但牙周袋不深，主要是由于牙周硬软组织破坏所致，牙松动甚至脱落；急性坏死性溃疡性牙龈炎：口腔恶臭，牙龈红肿，龈缘及龈乳头有灰黄色坏死组织，极易出血（E对）；坏死性牙周炎，以牙周软组织的坏死和缺损为特点，疼痛明显，牙槽骨破坏，牙齿松动。5.坏死性口炎，表现为广泛的组织坏死。6.溃疡性损害。7.唾液腺疾病。8.非霍奇金淋巴瘤。